在体内可发生芳环氧化、N-脱烷基和氧化脱胺代谢的药物是
A. 普萘洛尔
B. 丙磺舒
C. 苯妥英钠
D. 华法林
E. 水杨酸

正确答案：A。普萘洛尔

解析：本题考查普萘洛尔。在体内可发生芳环氧化、N-脱烷基和氧化脱胺代谢的药物是普萘洛尔（A对）。普萘洛尔结构中含有芳环，主要在芳环的对位发生羟基化反应；普萘洛尔也属于胺类的药物，可发生N-脱烷基和氧化脱胺反应。丙磺舒（B错）的苯环上有多个吸电子取代基，苯环的电子云密度减少，苯环不被氧化。苯妥英（C错）在体内经过氧化反应，其中一个苯环被羟基化，生成带有手性结构的S-（-）-5-（4-羟基）化合物，并失去生物活性。华法林（D错）因代谢过程中苯环被氧化，生成新的手性中心。S-（-）-华法林的主要代谢产物是7-羟基化物，而华法林的R-（+）-对映异构体的代谢产物为侧链酮基的还原产物。